下列哪项不是冠延长术的禁忌证
A. 牙根比较短
B. 牙齿折断达龈下
C. 为暴露牙齿断缘需切除的牙槽骨过多
D. 剩余牙槽骨高度不足
E. 全身情况不佳的患者

正确答案：B。牙齿折断达龈下

解析：冠延长术禁忌证：①牙根过短，冠根比例失调；②牙齿折断达龈下过多，为暴露牙齿断缘做骨切除术后，剩余的牙槽骨高度不足以支持牙齿行使功能；③为暴露牙齿断缘需切除的牙槽骨过多，会导致与邻牙不协调或明显地损害邻牙；④全身情况不宜手术。掌握“牙周健康与修复”知识点。